男，68岁。阵发性腹痛1年，自觉有“气块”在腹中窜动，起初大便次数增加，近3个月腹胀、便秘，近3天无肛门排气、排便，呕吐物有粪便臭味，一直感乏力和低热。根据病史考虑肠梗阻应为
A. 高位不完全梗阻
B. 血运性肠梗阻
C. 高位完全梗阻
D. 低位不完全梗阻
E. 低位完全梗阻

正确答案：E。低位完全梗阻

解析：该患者近3天无肛门排气排便，呕吐物有粪便臭味，提示有低位性完全梗阻（ E对）。高位不完全梗阻和高位完全性梗阻呕吐物为胃内容（AC错）。血运行肠梗阻呕吐物为血性物（B错）。低位不完全梗阻表现为呕吐物为粪臭物，但无停止排气排便（D错）。